治疗指数是指
A. 比值越大就越不安全
B. ED₅₀/LD₅₀
C. ED₅₀/TD₅
D. 比值越大，药物毒性越大
E. LD₅₀/ED₅₀

正确答案：E。LD₅₀/ED₅₀

解析：治疗指数：是药理学名词，为半数致死量除以半数有效量的比值